因服用过量而发生药物不良反应，可致呼吸麻痹而死亡的中药是
A. 细辛
B. 使君子
C. 胆矾
D. 雷公藤
E. 香加皮

正确答案：A。细辛

解析：本题考查的是中药饮片的不良反应。因服用过量而发生药物不良反应，可致呼吸麻痹而死亡的中药是细辛（A对）。细辛的不良反应表现：细辛中的挥发油直接作用于中枢神经系统，最终可因呼吸中枢完全麻痹而致死。细辛的急性毒性对小鼠肺、肝、肾等重要脏器均有明显损害，其中对肺脏的病理损害最为严重。细辛中毒时，常可出现头痛、呕吐、出汗、口渴、烦躁不安、面赤、呼吸急促、脉数、瞳孔散大，体温血压均升高；个别出现心慌、气短、胸闷，动则加重，窦性心动过速及双下肢水肿等急性心力衰竭症状，或精神紧张，失眠，胆小易惊，心悸、濒死感，面色萎黄灰暗，多发性阵发性窦性心动过速等心律失常伴自主神经紊乱等。严重者可出现牙关紧闭、角弓反张、意识不清、四肢抽搐、尿闭，最后因呼吸麻痹而死亡。胆矾（C错）的不良反应表现：①消化系统：流涎、恶心、呕吐、腹痛、腹泻、呕血、便血等，口涎、呕吐物、粪便多呈蓝绿色，口中有特殊金属味；黄疸、中毒性肝炎等症状。②血液系统：溶血性贫血。③泌尿系统：蛋白尿、血尿、少尿、无尿、氮质血症、急性肾功能衰竭或尿毒症等。④循环系统：血管麻痹、血压下降。铜离子对心脏损害可引起中毒性心肌炎，表现心动过速、心律失常及心力衰竭。⑤神经系统：头痛头晕、全身乏力，严重者出现脑水肿、痉挛、神经麻痹、谵妄、意识障碍等中毒性脑炎症状。雷公藤（D错）的不良反应表现：①消化系统：腹痛、腹泻，恶心、呕吐，食欲不振，肝损害，少数可致伪膜性肠炎，严重者可致消化道出血。②血液系统：血小板、白细胞、血红蛋白减少，严重者可发生急性粒细胞减少、再生障碍性贫血等。③生殖系统：对男性患者雷公藤可抑制精细胞中酶的活性，导致精子产生和成熟发生障碍，表现为精子数量显著减少，长期用药还会导致性欲减退、睾丸萎缩；对女性患者雷公藤可抑制其卵巢功能，表现为月经紊乱、经量减少、卵巢早衰。④神经系统：头晕、乏力、失眠、听力减退、嗜睡、复视，还可引起周围神经炎。⑤泌尿系统：主要表现为急性肾功能衰竭，服药后迅速出现或逐渐发生少尿、水肿、血尿、蛋白尿、管型尿、腰痛或伴肾区叩击痛，常常发生于过量中毒时。⑥心血管系统：心悸、胸闷、心动过缓、气短、心律失常、心电图改变（ST-T改变），严重者可见血压急剧下降，个别出现室颤、心源性休克而死亡。⑦皮肤黏膜损害：皮肤糜烂、溃疡、斑丘疹、荨麻疹、瘙痒等。香加皮（E错）的不良反应表现：①消化系统：主要为恶心、呕吐、腹泻等胃肠道症状。②心血管系统：主要为心律失常，如心率减慢、早搏、房室传导阻滞等。动物毒性实验表明香加皮中毒后多表现为血压先升而后下降、心肌收缩力增强、每分钟心输出量增加，继而心输出量减弱、心律失常，乃至心肌纤颤而死亡。使君子（B错）的不良反应表现，2022年考试指南未明确说明。